某男性患者，30岁，有吸毒史（注射）。近半年来体重减轻，发烧，口腔反复发生真菌感染。首先考虑为AIDS。首先应使用药物治疗的是
A. HIV感染
B. 止呕
C. 降温
D. 止泻
E. 真菌感染

正确答案：E。真菌感染

解析：本题考查HIV感染口腔疾病的治疗。某男性患者，30岁，有吸毒史（注射）。近半年来体重减轻，发烧，口腔反复发生真菌感染。首先考虑为AIDS。首先应使用药物治疗的是真菌感染（E对），同时给予对症治疗：止呕（B错）、降温（C错）、止泻（D错）。在病情控制稳定后，再开始HIV感染的治疗（A错）。